以下对（牙合）支托功能的描述哪项不正确
A. 防止义齿龈向移位
B. 保持卡环在基牙上的位置
C. 防止食物嵌塞
D. 防止义齿侧向及（牙合）向移位
E. 恢复咬合关系

正确答案：D。防止义齿侧向及（牙合）向移位

解析：本题考查（牙合）支托的作用。防止义齿侧向及（牙合）向移位（D错，为本题的正确答案）主要是卡环臂的作用，与（牙合）支托功能无关。支托的作用包括：1.支承、传递（牙合）力：支托可将义齿承受的咀嚼压力传递到天然牙上，而基牙对义齿的支持力也通过支托起作用，防止义齿龈向移位（A对）。2.稳定义齿：与卡环整铸连用时可保持卡环在基牙上的位置（B对）。3.防止食物嵌塞和恢复（牙合）关系：若余留牙之间有间隙，放置支托可防止食物嵌塞（C对），若基牙因倾斜或低位等原因，与对颌牙无咬合接触或接触不良者，还可以加大支托，以恢复不良咬合关系（E对）。